口腔颌面部外伤后组织容易肿胀的原因是
A. 颌面部损伤一般比较严重
B. 口腔颌面部腔窦比较多
C. 口腔颌面部血运丰富易形成血肿
D. 颌面部咀嚼运动比较多
E. 颌面部腺体比较多

正确答案：C。口腔颌面部血运丰富易形成血肿

解析：本题考查口腔颌面部创伤概论。口腔颌面部血运丰富在损伤时的利弊：由于血运丰富，伤后出血较多，易形成血肿（C对）；组织水肿反应快而重，如口底、舌根或下颌下等部位损伤，可因水肿、血肿而影响呼吸道通畅，甚至引起窒息。另一方面，由于血运丰富，组织抗感染与再生修复能力较强，创口易于愈合；因此，清创术中应尽量保留组织，减少缺损，争取初期缝合。